投照上前牙时，应使
A. 听鼻线与地面平行
B. 前牙的唇侧面与地面垂直
C. 听口线与地面平行
D. 听眶线与地面平行
E. 咬合平面与地面平行

正确答案：B。前牙的唇侧面与地面垂直

解析：本题考查投照技术时患者的位置。投照上颌前牙时，前牙的唇侧面与地面垂直（B对）。投照上颌后牙时，外耳道口上缘至鼻翼之连线（听鼻线）与地面平行（A错）。听口线与地面平行（C错）是投照下颌后牙时采用的方法。投照下颌前牙时，头稍后仰，使前牙的唇侧面与地面垂直。拍不同牙齿采用相对应的位置可以提高图像的真实性和准确性，从而更加有利于疾病的诊断。拍摄根尖片时患者的位置中没有听眶线与地面平行（D错）和咬合平面与地面平行（E错）这两个位置。